四君子汤除益气外，还具有的功用是
A. 健脾养心
B. 健脾养胃
C. 健脾温胃
D. 健脾益阴
E. 健脾温阳

正确答案：B。健脾养胃

解析：四君子汤方以人参为君，甘温益气，健补脾胃。脾胃气虚，运化失常，故臣以白术，既助人参补益脾胃之气；更以其苦温之性，健脾燥湿，助脾运化。脾主湿，脾胃既虚，运化无力，则湿浊易于停滞，故佐以补利兼优之茯苓，配白术健运脾气；又以其甘淡之性，渗利湿浊，且使参、术补而不滞。伍用炙甘草者，以其甘温益气，助参、术补中益气之力；更兼调和诸药，而司佐使之职。四药皆为甘温和缓之品，而呈君子中和之气，故以"君子"为名。四药合力，重在健补脾胃之气，兼司运化之职，且渗利湿浊，共成益气健脾之功（B对）。归脾汤的功用为益气补血，健脾养心（A错）。实脾散的功效有健脾温阳（E错）。